经产妇，31岁。现妊娠35周。查体：BP120/80mmHg，宫底35cm，胎心136次/分。空腹血糖6.2mmol/L，尿糖（+）。2年前因妊娠8个月死胎行引产术。经控制饮食2周后，空腹血糖6.1mmol/L，胎心136次/分，无应激试验无反应型。此时最恰当的措施是
A. 左侧卧位
B. 间断吸氧
C. 自行胎动计数
D. 立即终止妊娠
E. 胎儿生物物理评分

正确答案：D。立即终止妊娠

解析：胎儿为无应激试验无反应型，提示胎儿严重缺氧，因患者有不良生产史，此时最恰当的措施为立即终止妊娠（D对）。左侧卧位（A错）和间断吸氧（B错）为一般性治疗措施。自行胎动计数（C错）对监测和诊疗胎儿无应激试验无反应型意义不大。胎儿生物物理评分需要时间比较长，现临床应用已减少（E错）。